翼点的组成不包括
A. 额骨
B. 颞骨
C. 蝶骨
D. 顶骨
E. 枕骨

正确答案：E。枕骨

解析：本题考查翼点的组成。翼点的组成不包括枕骨（E错，为本题的正确答案）。翼点是额骨（A对）、颞骨（B对）、蝶骨（C对）和顶骨（D对）相交处所形成的H形骨缝，位于颞窝内，颧弓中点上方两横指（或3.5～4cm）处，内有脑膜中动脉前支通过，且深面有运动型语言中枢，此处骨质薄弱，受暴力打击易骨折，损伤血管形成硬膜外血肿。枕骨是颅骨的后部分，位于顶骨之后，并延伸至颅底，以枕骨大孔为汇总中心，枕骨可分为四个部分：后为鳞部，前为基底部，两侧为侧部，枕骨与顶骨、颞骨及蝶骨相连，不参与翼点的构成。